急性胃穿孔应选用的检查方法是
A. 立位腹部平片和透视
B. 腹部B超
C. 上消化道钡剂造影
D. 腹部穿刺检查
E. 腹部MRI检查

正确答案：A。立位腹部平片和透视

解析：立位腹部平片和透视（A对）是不用引入任何造影而拍摄的腹部照片，当某种脏器因疾病而发生钙化或有不透X线的异物、结石，或腹腔内有游离气体出现，肠腔内气体、液体增多或肠管有扩张时，就会出现密度高低的差别而在照片上显示出来，急性胃穿孔时，可在膈下看到新月形阴影。腹部B超（B错）对腹部实质性脏器的占位性病变有较高的诊断价值。上消化道钡剂造影（C错），在疑诊胃穿孔时禁做上消化道钡剂造影。腹部穿刺检查（D错）对腹水的诊断有较高的诊断价值。腹部MRI检查（E错）对腹腔内占位性病变有较高的诊断价值。